预防早期婴幼儿童龋的论述中，不正确的是
A. 长期睡前含奶瓶可导致上前牙龋坏
B. 提倡母乳喂养
C. 不定时哺乳
D. 龋的发生与饮食密切相关
E. 避免随意哺乳

正确答案：C。不定时哺乳

解析：早期婴幼儿龋是发生在婴幼儿期的与饮食密切相关的多因素作用下的慢性感染性疾病。婴儿期常用奶瓶盛含糖的牛奶、果汁等喂养，尤其人工喂养睡前含奶瓶习惯，长期可导致上前牙龋坏。应提倡母乳喂养，定时哺乳，避免随意哺乳。掌握“婴幼儿的口腔保健”知识点。